犀角地黄汤适用于急性热病的哪种证型
A. 阳明热盛
B. 气血两燔
C. 热灼营阴
D. 热盛迫血
E. 热与血结

正确答案：D。热盛迫血

解析：犀角地黄汤中以犀角为君，凉血清心解热毒，主治热入血分证（D对）。阳明热盛（A错）选用白虎汤；气血两燔（B错）选用清瘟败毒饮；热灼营阴（C错）选用清营汤；热与血结（E错）选用黄连解毒汤。